一患者，右上4近中颊大面积银汞充填，死髓牙，患者美观要求高，最佳修复设计是
A. 金合金全冠
B. 树脂嵌体
C. 金属烤瓷冠
D. 塑料全冠
E. 3/4冠

正确答案：C。金属烤瓷冠

解析：本题考查金属烤瓷冠的适应证。患者，右上4近中颊大面积银汞充填，死髓牙，患者美观要求高，最佳修复设计是金属烤瓷冠（C对）。患牙近中颊面大部分缺损，缺损范围大，剩余牙体组织强度差，采用嵌体修复（B错）和3/4冠修复（E错）抗力不足，应选择全冠修复。塑料全冠（D错）不用于永久修复，多用于暂时性修复。且患者对美观要求高，不适合采用金合金全冠（A错），因而宜采用外观逼真，色泽美观，且耐磨性，抗折力较强的金属烤瓷冠。